主要阻滞电压依赖性的钠通道，属于二苯并氮䓬类抗癫痫药的是
A. 卡马西平
B. 苯妥英钠
C. 丙戊酸钠
D. 苯巴比妥
E. 氯硝西泮

正确答案：A。卡马西平

解析：本题考查二苯并氮䓬类抗癫痫药。卡马西平（A对）主要阻滞电压依赖性的钠通道，属于二苯并氮䓬类抗癫痫药；苯妥英钠（B错）属于乙内酰脲类抗癫痫药，可通过减少钠离子内流而使神经细胞膜稳定，限制Na⁺通道介导的发作性放电的扩散；丙戊酸钠（C错）为脂肪酸类抗癫痫药，其作用机制为抑制γ-氨基丁酸（GABA）的降解或促进其合成，从而增加脑内GABA浓度，促使Cl⁻内流，使胞膜的超极化稳定，达到抗癫痫作用；苯巴比妥（D错）属于巴比妥类抗癫痫药，可通过增强γ-氨基丁酸A型受体活性，抑制谷氨酸兴奋性，抑制中枢神经系统单突触和多突触的传递，增加运动皮质的电刺激阈值，从而提高癫痫发作的阈值，抑制病灶异常放电向周围正常组织扩散；氯硝西泮（E错）可激动γ-氨基丁酸（GABA）受体和钠通道，属于苯二氮䓬类抗癫痫药。